某疟疾患者突发畏寒寒战，体温达39℃，这主要是由于
A. 体温调定点上调
B. 皮肤血管扩张
C. 散热中枢兴奋
D. 产热中枢抑制
E. 体温调节功能障碍

正确答案：A。体温调定点上调

解析：机体保持体温相对稳定是机制可以用体温调定点学说解释：体温调节中枢按照体温调定点设定的温度进行调节活动，当体温调定点上调（A对）时，人体出现畏寒、寒战等现象，促使机体产热活动加强（D错），散热活动减弱，直到体温升高到39℃以上时才出现散热反应。在体温回到调定点水平之前，皮肤血管收缩（B错），机体散热活动减弱（C错）。体温调节中枢功能异常（P237）（E错）可导致中暑，不出现畏寒、寒战。